儿童维生素A缺乏最重要的临床诊断体征是
A. 白内障
B. 比奥斑
C. 角膜溃疡
D. 结膜溃疡
E. 眼球突出

正确答案：B。比奥斑